较易发生氧化降解的药物是
A. 青霉素
B. 头孢唑啉
C. 肾上腺素
D. 氨苄青霉素
E. 乙酰水杨酸

正确答案：C。肾上腺素

解析：本题考查药物的氧化降解。较易发生氧化降解的药物是肾上腺素（C对）。肾上腺素中含有酚羟基易发生氧化反应。分子结构中含有酚羟基的酚类药物、含有不饱和碳键的药物以及芳胺药物，较易氧化降解。青霉素（A错）、头孢唑啉（B错）、氨苄青霉素（D错）、属于β-内酰胺类抗生素，通过水解降解。乙酰水杨酸（E错）的降解途径也是水解。